根据《药品经营质量管理规范实施条例》，退货药品库
A. 红色色标
B. 黄色色标
C. 绿色色标
D. 蓝色色标
E. 橙色色标

正确答案：B。黄色色标

解析：本题考察色标管理。退货药品库使用黄色色标（B对）。